乳癖的肿块特点是
A. 质地中等，表面光滑，活动度好，伴有胀痛
B. 坚硬如石，表面不平，固定不活动，与皮肤粘连
C. 结节样肿块，位于乳晕下，按压乳窍溢血
D. 肿胀疼痛，皮肤灼热锨红，形成脓肿
E. 肿块扁圆，多位于乳晕中央，轻度疼痛

正确答案：A。质地中等，表面光滑，活动度好，伴有胀痛

解析：乳癖相当于西医的乳腺增生病，乳房疼痛以胀痛为主，也有刺痛或牵拉痛，疼痛常在月经前加剧，经后疼痛减轻，或疼痛随情绪波动而变化；乳房肿块可发生于单侧或双侧，大多位于乳房的外上象限，也可见于其他象限 肿块的质地中等或质硬不坚，表面光滑或颗粒状，活动度好，大多伴有压痛，肿块的大小不一（A对）。乳岩相当于西医的乳腺癌，其特点是乳房部出现无痛、无热、皮色不变而质地坚硬的肿块，推之不移，表面不光滑，或乳头溢血（B错）。乳衄的特点是乳头单个或多个乳孔溢出血性液体，或有乳晕下单发肿块，轻按肿物时，即可从乳头内溢出血性或黄色液体（C错）。乳痈相当于西医的急性化脓性乳腺炎，以患乳红、肿、热、痛，甚则化脓，脓后逐渐痊愈或迁延不愈为主要表现（D错）。乳疬相当于西医的乳房异常发育症。其特点是乳晕中央有扁圆形肿块，质地中等，有轻压痛（E错）。